治疗佝偻病活动早期口服法，每日给维生素D剂量为
A. 0.5万～1万IU
B. 0.2～0.4万IU
C. 1～2万IU
D. 3万～4万IU
E. 5万～6万IU

正确答案：B。0.2～0.4万IU

解析：本题考查维生素D缺乏性佝偻病。补充维生素D制剂口服法：每日给维生素D,0.2万～0.4万IU（B对），或1，25-（OH）2D3（罗盖全）0.5～2.0μg，连服2～4周后改为预防量，恢复期可用预防量维持。